制定某物质的卫生标准的依据是
A. 中毒剂量
B. 阈剂量或阈下剂量
C. 耐受剂量
D. 吸入剂量或吸收剂量
E. 观察到有害作用的最低量

正确答案：B。阈剂量或阈下剂量

解析：本题考查制定某物质的卫生标准的依据。制定某物质的卫生标准的依据是阈剂量或阈下剂量（B对ACDE错）。